下列属于氨基糖苷类抗生素的药物是
A. 阿米卡星
B. 红霉素
C. 土霉素
D. 阿昔洛韦
E. 利福喷丁

正确答案：A。阿米卡星

解析：本题考查氨基糖苷类抗生素。阿米卡星（A对）为氨基糖苷类抗生素，抗菌谱广。红霉素（B错）为大环内酯类抗生素，抗菌谱与青霉素相似。土霉素（C错）为四环素类抗生素，广谱抑菌剂。阿昔洛韦（D错）为是核苷类抗病毒药。利福喷丁（E错）抗菌谱性质与利福平相同。